以下哪种脉象主阳极阴竭
A. 结脉
B. 代脉
C. 疾脉
D. 促脉
E. 散脉

正确答案：C。疾脉

解析：“疾脉，脉象特征：脉来急疾，一息七八至，临床意义：多见于阳极阴竭，元阳将脱”（C对）。“结脉，脉象特征：脉来缓慢，时有中止，止无定数，临床意义：多见于阴盛气结、寒痰血瘀、亦可见于气血虚衰”（A错）。“代脉，脉象特征：脉来一止，止有定数，良久方还，临床意义：见于脏气衰微、疼痛、惊恐、跌扑损伤等病症”(B错)。“促脉，脉象特征：脉来数而时一止，止无定数，临床意义：多见于阳盛实热、气血痰食郁滞；亦见于脏气衰败”（D错）。“散脉，脉象特征：浮取散漫，中候似无，沉候不应，并常伴有脉动不规则，时快时慢而不匀（但无明显歇止），或脉力往来不一致，临床意义：多见于元气离散，脏腑精气衰败，尤其是心、肾之气将绝的危重病症”（E错）。